白雪在晚霞的映照下，呈现出红色，但是我们对雪地的知觉仍然是白色。这是因为人的知觉具有
A. 理解性
B. 对比性
C. 整体性
D. 组织性
E. 恒常性

正确答案：E。恒常性